重金属铜中毒的特异性解救药物是
A. 氟马西尼
B. 亚甲蓝
C. 乙酰半胱氨酸
D. 青霉胺
E. 纳洛酮

正确答案：D。青霉胺

解析：本题考查特殊解毒剂。青霉胺（D对）（D-盐酸青霉胺）用于铜、汞、铅中毒的解毒，治疗肝豆状核变性病。